患者，女，67岁，入院后行左侧髋关节置换术，术前12小时皮下注射低分子肝素预防深静脉血栓。术后患者情况稳定，继续使用低分子肝素，住院第7天出院。患者出院后的1个月内，需要继续使用药物预防深静脉血栓，宜选用的药物是
A. 氯吡格雷
B. 替格瑞洛
C. 利伐沙班
D. 双嘧达莫
E. 西洛他唑

正确答案：C。利伐沙班

解析：本题考查利伐沙班。患者出院后的1个月内，需要继续使用药物预防深静脉血栓，宜选用的药物是利伐沙班（C对）。利伐沙班是新型抗凝药物，可用于治疗成人深静脉血栓形成（DVT）和肺栓塞（PE），降低初始治疗6个月后深静脉血栓形成和肺栓塞复发的风险。氯吡格雷（A错）是用于不能耐受阿司匹林的患者的抗血小板聚集药物。替格瑞洛（B错）用于急性冠脉综合征患者。双嘧达莫（D错）一般用于冠心病的治疗。西洛他唑（E错）主要用于限有慢性动脉闭塞症诊断且明确的溃疡、间歇性跛行及严重疼痛体征的患者。